确诊前列腺癌最可靠的方法是
A. 直肠指诊
B. 穿刺活检
C. MRI
D. 核素扫描
E. CT

正确答案：B。穿刺活检

解析：前列腺癌的诊断的主要方法有直肠指检，血清前列腺特异性抗原测定和超声引导下前列腺穿刺活检，其中超声引导下前列腺穿刺活检（B对）是确诊前列腺癌最可靠的方法。直肠指检（A错）发现质硬的前列腺结节，多用于前列腺癌的初诊检查。MRI（C错）对前列腺癌的诊断和临床分期具有重要价值，可作为前列腺癌的辅助诊断方法。核素骨扫描（D错）主要用于发现前列腺癌有无骨转移病灶。CT（E错）对早期前列腺癌的诊断价值不大，对晚期周围组织受累和盆腔淋巴结转移情况显示较好。